用于各种哮喘及急性心功能不全的药物是
A. 二丙酸倍氯米松
B. 可待因
C. 沙丁胺醇
D. 氨茶碱
E. 色甘酸钠

正确答案：D。氨茶碱

解析：本题考查氨茶碱。用于各种哮喘及急性心功能不全的药物是氨茶碱（D对）。氨茶碱主要用于各种哮喘及急性心功能不全。二丙酸倍氯米松（A错）为吸入型糖皮质激素，用于持续性哮喘的长期治疗。可待因（B错）为中枢性镇咳药。沙丁胺醇（C错）为选择性β₂受体激动剂，用于治疗支气管哮喘或喘息性慢性支气管炎伴支气管痉挛。色甘酸钠（E错）为肥大细胞膜稳定剂，用于治疗过敏性哮喘。